胎盘的组成
A. 羊膜，叶状绒毛膜和底蜕膜
B. 羊膜，平滑绒毛膜和包蜕膜
C. 羊膜，叶状绒毛膜和包蜕膜
D. 羊膜，平滑绒毛膜和底蜕膜
E. 羊膜，平滑绒毛膜和真蜕膜

正确答案：A。羊膜，叶状绒毛膜和底蜕膜

解析：胎盘的组成为羊膜、叶状绒毛膜和底蜕膜（A对）。羊膜为附着在胎盘胎儿面的半透明薄膜。叶状绒毛膜由滋养层和胚外中胚层共同组成。蜕膜分为3部分：底蜕膜（P32）来自胎盘附着部位的子宫内膜；包蜕膜（P37）为覆盖在囊胚表面的蜕膜，随着囊胚发育逐渐突向宫腔；真蜕膜（P37）为底蜕膜及包蜕膜以外覆盖子宫腔其他部分的蜕膜，其中只有底蜕膜是胎盘的组成部分。平滑绒毛膜（P35）为囊胚表面非着床部位的绒毛膜在发育过程中缺乏营养逐渐退化萎缩形成，不是胎盘的组成部分。